给某患者静脉注射（推注）某药，已知剂量X₀=500mg·h⁻¹，∑=-10h，该患者给药达稳态后的平均稳态血药浓度是
A. 0.05mg/L
B. 0.5mg/L
C. 5mg/L
D. 50mg/L
E. 500mg/L

正确答案：D。50mg/L

解析：本题考查单室模型静脉注射给药。根据静脉注射给药的表观分布容积计算公式V=X₀/C₀，可知初始血药浓度C₀=X₀/V=500mg/10L=50mg/L（D对），根据题意初始血药浓度C₀即为患者给药后达稳态的平均稳态血药浓度。